具有和胃健脾、导滞消积功能的藏药是
A. 五味渣驯丸
B. 六味安消散
C. 七味红花殊胜丸
D. 八味沉香散
E. 十味黑冰片丸

正确答案：B。六味安消散

解析：本题考查的是六味安消散的功能。具有和胃健脾、导滞消积功能的藏药是六味安消散（B对）。六味安消散的功能与主治：和胃健脾，消积导滞，活血止痛。用于脾胃不和，积滞内停所致的胃痛胀满、消化不良、便秘、痛经。五味渣驯丸（A错）的用于肝炎、肝肿大等。七味红花殊胜丸（C错）的功能与主治：清热消炎，保肝退黄。用于新旧肝病，巩膜黄染，食欲不振等。八味沉香散（D错）的功能与主治：清心热，养心，安神，开窍。用于热病攻心，神昏谵语；冠心病，心绞痛。十味黑冰片丸（E错）的功能与主治：温胃消食，破积利胆。用于龙病，食积不化，恶心，培根痞瘤，胆囊炎，胆结石及黄疸。